下列不是HAV主要传播因素的是
A. 受污染的食品
B. 被污染的水
C. 血液
D. 食用被污染的水生动植物
E. 接触被污染的物体

正确答案：C。血液